能除烦止呕的药是
A. 知母
B. 芦根
C. 竹叶
D. 青葙子
E. 天花粉

正确答案：B。芦根

解析：本题考查的是芦根的功效。能除烦止呕的药是芦根（B对）。芦根：【功效】清热生津，除烦止呕，利尿。知母（A错）：【功效】清热泻火，滋阴润燥。竹叶（C错）：【功效】清热除烦，生津，利尿。青葙子（D错）：【功效】清肝泻火，明目退翳。天花粉（E错）：【功效】清热生津，清肺润燥，消肿排脓。